下列药物可采用的含量测定方法为：维生素B₁
A. 三点校正紫外分光光度法
B. 高效液相色谱法
C. 非水溶液滴定法
D. 溴量法
E. Kober反应比色法

正确答案：C。非水溶液滴定法